肉眼形态表现为颗粒性固缩肾的疾病是
A. 慢性硬化性肾小球肾炎
B. 慢性肾盂肾炎
C. 急性弥漫性增生性肾小球肾炎
D. 膜性肾小球肾炎
E. 新月体性肾小球肾炎

正确答案：A。慢性硬化性肾小球肾炎

解析：慢性硬化性肾小球肾炎（A对）即慢性肾小球肾炎，是不同类型肾小球肾炎发展的终末阶段。肉眼观，双肾体积缩小，表面呈弥漫性细颗粒状，故称为继发性颗粒性固缩肾。